异丙肾上腺素不宜用于
A. 房室传导阻滞
B. 心脏骤停
C. 支气管哮喘
D. 冠心病
E. 感染性休克

正确答案：D。冠心病

解析：异丙肾上腺素用量过大，心肌耗氧量加大容易产生心律失常，严重者可引起室性心动过速及室颤而死亡，禁用于冠心病（D错，为本题正确答案）、心肌炎和甲状腺功能亢进病人。异丙肾上腺素舌下含药或静脉滴注给药可用于治疗Ⅱ、Ⅲ度房室传导阻滞（A对）。异丙肾上腺素适用于心室自身节律缓慢，高度房室传导阻滞或窦房结功能衰竭而并发的心搏骤停（B对），常与肾上腺素或间羟胺一起用作心室内注射。异丙肾上腺素用于控制支气管哮喘（C对）急性发作，舌下或喷雾给药，起效较快。异丙肾上腺素具有兴奋心脏、促进代谢的作用，可用于感染性休克（E对）。